最有助于提示室性心动过速的依据是
A. QRS波群宽大畸形
B. 心律规则
C. 心室夺获
D. P波消失
E. ST段斜型压低

正确答案：C。心室夺获

解析：室性心动过速简称室速，心电图检查可出现心室夺获，是由室速发作时少数室上性冲动下传心室产生，表现为在P波之后，提前发生一次正常的QRS波。室性融合波的QRS波形态介于窦性与异位心室波动之间，其意义为部分夺获心室。心室夺获（C对）和室性融合波的存在是诊断室速的重要依据。QRS宽大畸形（A错）可见于室性期前收缩，也可见于室上性心动过速伴差异性传导，不具特异性。室速患者心脏听诊心律轻度不规则（B错）。P波消失（D错）多见于心房扑动、心房颤动，室速可见窦性P波。ST斜下性压低（E错）提示心肌缺血，多为稳定型心绞痛发作时的心电图表现。